与苯比较，苯乙烯经呼吸道吸收的危害程度较小是由于其
A. 脂水分配系数大
B. 脂水分配系数小
C. 分子量小
D. 挥发度小
E. 挥发度大

正确答案：D。挥发度小